某药在下列5种制药的标示量为20mg，不需要检查均匀度的是
A. 片剂
B. 硬胶囊剂
C. 内容物为均一溶液的软胶囊
D. 注射用无菌粉末
E. 单剂量包装的口服混悬液

正确答案：C。内容物为均一溶液的软胶囊

解析：本题考查胶囊剂。某药在下列5种制药的标示量为20mg，不需要检查均匀度的是内容物为均一溶液的软胶囊（C错，为本题正确答案）。内容物为均一溶液的软胶囊，由于其内容物为均一的溶液，故不需进行含量均匀度检查。除另有规定外，片剂（A对）、硬胶囊剂（B对）、颗粒剂或散剂等，每一个单剂标示量小于25mg或主药含量小于每一个单剂重量25%者；药物间或药物与辅料间采用混粉工艺制成的注射用无菌粉末（D对）；内充非均相溶液的软胶囊；单剂量包装的口服混悬液（E对）、透皮贴剂和栓剂等品种项下规定含量均匀度应符合要求的制剂，均应检查含量均匀度。复方制剂仅检查符合上述条件的组分，多种维生素或微量元素一般不检查含量均匀度。